有关ATP合成机制的叙述正确的是
A. 除α、β亚基外，其他亚基有ATP结合部位
B. 在ATP合酶F1部分进行
C. F0部分仅起固定F1部分作用
D. F1α、β亚基构成质子通道
E. H+自由透过线粒体内膜

正确答案：B。在ATP合酶F1部分进行